属黄体功能不全的病证是
A. 崩漏
B. 月经过多
C. 经期延长
D. 月经先期
E. 月经后期

正确答案：D。月经先期

解析：月经先期是指月经周期提前7天以上，甚至10余天一行，连续3个周期以上，常常考虑是由于黄体功能不足，或者是卵巢早衰等原因引起（D对）；崩漏是指妇女不在行经期，阴道大量出血，或持续下血淋漓不断，又称"崩中漏下"（A错）；月经过多是连续数个周期月经期出血量多，失血量多于80毫升，但月经间隔时间及出血时间皆规则的一种临床症状，由于神经内分泌功能失调、卵巢功能异常、器质性病变或药物等因素导致（B错）；经期延长指月经期超过7天，甚至淋漓不尽到15天，原因有子宫内膜息肉、子宫肌瘤、宫外孕、宫颈疾病、全身性疾病等（C错）；月经后期是指月经周期延后7天以上，甚至3到5个月，连续两个周期以上者（E错）。